上前牙牙槽突骨折，应用
A. 单颌牙弓夹板结扎复位固定
B. 颌间结扎牵引复位固定
C. 颌间结扎固定
D. 颌间结扎加颅颌绷带复位固定
E. 骨间固定加牙弓夹板固定

正确答案：A。单颌牙弓夹板结扎复位固定

解析：牙槽突骨折的治疗应在局麻下将牙槽突及牙复位到正常解剖位置，然后利用骨折邻近的正常牙列，用牙弓夹板、金属丝和正畸托槽方丝弓等方法固定。注意应跨过骨折线至少3个正常牙位，才能固定可靠。掌握“牙槽突骨折、颌骨骨折”知识点。